女，60岁，G₄P₄。近两年来阴道脱出一肿物，逐渐增大。妇科检查：宫颈光滑，屏气用力后宫颈和部分宫体脱出阴道口外，子宫萎缩，双侧附件正常。对该患者子宫脱垂程度判断正确的是
A. Ⅰ度轻型
B. Ⅲ度
C. Ⅱ度轻型
D. Ⅰ度重型
E. Ⅱ度重型

正确答案：E。Ⅱ度重型

解析：该患者为老年女性，G4P4（孕4产4，生产次数较多，为子宫脱垂的高危因素）宫颈光滑，子宫萎缩，双侧附件正常，屏气用力后宫颈和部分宫体脱出阴道口外（Ⅱ度重型：宫颈及部分宫体脱出阴道口），诊断为Ⅱ度重型子宫脱垂（E对）。子宫脱垂分为3度：Ⅰ度轻型（A错）：宫颈外口距处女膜＜4cm，未达处女膜缘；重型（D错）：宫颈已达处女膜缘，阴道口可见宫颈。Ⅱ度轻型（C错）：宫颈脱出阴道口，宫体仍在阴道内；重型（E对）：宫颈及部分宫体脱出阴道口。Ⅲ度（B错）：宫颈及宫体全部脱出阴道口外。